下列哪项不是月经先期肝郁血热证的主症
A. 月经提前8天
B. 经量或多或少
C. 经色淡、质稀
D. 心烦易怒
E. 口苦咽干

正确答案：C。经色淡、质稀

解析：肝郁化热，热扰冲任，经血妄行，故月经提前（A对）；肝郁疏泄失调，血海失司，故经量或多或少（B对）；热灼于血，故经色深红或紫红，质稠（C错，为本题正确答案）；气滞血瘀，则经行不畅，或有血块；气滞肝经则胸胁、少腹胀痛；烦躁易怒（D对），口苦咽干（E对），舌红，苔薄黄，脉弦数均为肝郁化热之象。